苯妥英钠的消除速率与血药浓度有关。在低浓度（低于10㎍/ml）时，消除过程属于一级过程；高浓度时由于肝微粒体代谢酶能力有限，则按零级动力学消除，此时只要稍微增加剂量就可使血药浓度显著升高，易出现中毒症状。苯妥英钠在临床上的有效血药浓度范围是10～20㎍/ml。关于静脉注射苯妥英钠的血药浓度-时间曲线的说法，正确的是
A. 低浓度下，表现为线性药物动力学特征：剂量增加，消除半衰期延长
B. 低浓度下，表现为非线性药物动力学特征：不同剂量的血药浓度时间曲线
C. 高浓度下，表现为非线性药物动力学特征：AUC与剂量不成正比
D. 高浓度下，表现为线性药物动力学特征：剂量增加，半衰期不变
E. 高浓度下，表现为非线性药物动力学特征：血药浓度与剂量成正比

正确答案：C。高浓度下，表现为非线性药物动力学特征：AUC与剂量不成正比

解析：本题考查非线性动力学特征。高浓度下，表现为非线性药物动力学特征：AUC与剂量不成正比（C对）；高浓度时由于肝微粒体代谢酶能力有限，按零级动力学消除，表现为非线性药物动力学特征（D错）；AUC和平均稳态血药浓度与剂量不成正比（E错）；在低浓度（低于10㎍/ml）时，消除过程属于一级过程，故表现为线性药物动力学特征（B错），剂量增加，消除半衰期不变（A错）。